显微鉴别可见油室的药材有
A. 木香
B. 山药
C. 苦参
D. 苍术
E. 板蓝根

正确答案：A、D。木香；苍术

解析：本题考查的是木香与苍术粉末的显微鉴别。显微鉴别可见油室的药材有木香（A对）与苍术（D对）。木香：【性状鉴别】饮片呈类圆形或不规则的厚片，外表皮黄棕色至灰褐色，有纵皱纹。切面棕黄色至棕褐色，中部有明显菊花心状的放射纹理，形成层环棕色，褐色油点（油室）散在。气香特异，味微苦。苍术：【性状鉴别】饮片呈不规则类圆形或条形厚片，外表皮灰棕色至黄棕色，有皱纹，有时可见根痕。切面黄白色或灰白色，散有多数棕红色或橙黄色油点（油室），习称“朱砂点”，有的可析出白色细针状结晶。气香特异，味微甘、辛、苦。山药（B错）【显微鉴别】山药、山药片、麸炒山药粉末：草酸钙针晶束存在于黏液细胞中。淀粉粒单粒扁卵形、类圆形、三角状卵形或矩圆形，脐点短缝状或人字状。苦参（C错）：【性状鉴别】饮片呈类圆形或不规则的厚片，外表皮灰棕色或棕黄色，有时可见横长皮孔样突起，外皮薄，常破裂反卷或脱落，脱落处显黄色或棕黄色，光滑。切面黄白色，纤维性，具放射状纹理及裂隙，有的可见同心环纹。气微，味极苦。饮片加氢氧化钠试液数滴，栓皮部即呈橙红色，渐变为血红色，久置不消失。板蓝根（E错）：【性状鉴别】饮片呈圆形厚片。外表皮淡灰黄色至淡棕黄色，有纵皱纹。切面皮部黄白色，木部黄色。气微，味微甜后苦涩。